区别胆汁酸类与强心甾烯类成分，不能用
A. Kedde反应
B. Raymand反应
C. Legal反应
D. Liebermann-Burchard反应
E. Baljet反应

正确答案：D。Liebermann-Burchard反应

解析：本题考查的是强心苷的颜色反应。区别胆汁酸类与强心甾烯类成分，不能用Liebermann-Burchard反应（D错，为本题正确答案）。强心苷的颜色反应可由甾体母核、不饱和内酯环和α-去氧糖产生。（1）甾体母核的颜色反应：甾体类化合物在无水条件下用酸处理，能产生各种颜色反应。这类颜色反应的机制较复杂，是甾体化合物与酸作用，经脱水、缩合、氧化等过程而呈现一系列颜色变化。鉴别反应如下：①Liebermann-Burchard反应（醋酐-浓硫酸反应）；②Salkowski反应；③Tschugaev反应；④三氯化锑反应；⑤三氯乙酸-氯胺T反应。（2）C-17位上不饱和内酯环的颜色反应：甲型强心苷在碱性醇溶液中，由于五元不饱和内酯环上的双键移位产生C-22活性亚甲基，能与活性亚甲基试剂作用而显色。乙型强心苷在碱性醇溶液中，不能产生活性亚甲基，无此类反应。所以利用此类反应，可区别甲、乙型强心苷。所产生的有色化合物在可见光区常有最大吸收，故亦可用于定量。鉴别反应如下：①Legal反应（C错）；②Raymond反应（B错）；③Kedde反应（A错）；④Baljet反应（E错）。（3）α-去氧糖颜色反应：α-去氧糖颜色反应共有四个鉴别反应：①K-K反应；②呫吨氢醇反应；③对-二甲氨基苯甲醛反应；④过碘酸钠-对硝基苯胺反应。天然胆汁酸是胆烷酸的衍生物，胆烷酸的结构中有甾体母核。故胆汁酸类与强心甾烯类成分均能发生Liebermann-Burchard反应。